根据原国家卫生部发布的《全国自然灾害卫生应急预案》（试行），按灾害的性质将自然灾害分为以下几种，其中不包括在内的类别是
A. 气象灾害和海洋灾害
B. 水旱灾害
C. 地质灾害和地震灾害
D. 生物灾害和森林草原火灾
E. 核电事故

正确答案：E。核电事故

解析：本题考查自然灾害按灾害的性质的分类。自然灾害是指以自然变异为主要因素造成的，危害人类生命健康、财产、社会功能以及资源、环境，且超出受影响者利用自身资源进行应对和处置能力的事件或现象。根据国家原卫生部发布的《全国自然灾害卫生应急预案》（试行），按灾害的性质将自然灾害分为七大类：气象灾害、海洋灾害（A对）、水旱灾害（B对）、地质灾害、地震灾害（C对）、生物灾害和森林草原火灾（D对）。核电事故（E错，为本题正确答案）不是自然灾害按灾害的性质的分类。